院内感染的主要途径
A. 医疗器械
B. 医护人员直接传播
C. 呼吸道传播
D. 交叉感染
E. 内源性感染

正确答案：D。交叉感染

解析：院内感染的发生既可以由皮肤、鼻腔、消化道等部位的内源性常驻菌引起，也可以由医疗环境、医疗设备和器械、访客、医务人员带给患者的外源性病原体引起，亦称交叉感染（D对）。